社区口腔保健的重点是
A. 口腔健康调查
B. 口腔问卷调查
C. 口腔疾病预防
D. 口腔疾病的早期治疗
E. 口腔功能的恢复

正确答案：C。口腔疾病预防

解析：通过社区口腔保健可以增强人们的口腔保健意识，提高人群的自我口腔保健能力，纠正不良的口腔卫生习惯和行为方式，提高社区人群的口腔健康，达到预防口腔疾病、促进口腔健康的目的。掌握“社区口腔卫生服务”知识点。